A1DS消化系统常见的并发症是
A. 隐孢子虫感染
B. 隐球菌感染
C. 肺孢子菌感染
D. 口腔毛状白斑
E. 巨细胞病毒感染

正确答案：A。隐孢子虫感染

解析：艾滋病的发病期感染者常见的消化系统并发症主要为白色念珠菌食管炎，巨细胞病毒性食管炎及肠炎，沙门菌、痢疾杆菌、空肠弯曲菌及隐孢子虫性肠炎。其中肠道隐孢子虫感染较为常见（A对），表现为长达数月的慢性持续性腹泻，呈水样便。隐孢子虫、巨细胞病毒、结核杆菌。鸟分枝杆菌及药物可以马起脂肪肝肉芽肿性肝炎、肝硬化等。同性恋患者可见肛周疱疹病毒感染和疱疹性直肠炎。艾滋病病毒感染者进入临床发病期后，会出现各种严重机会性感染和肿瘤。其中出现在呼吸系统最常见的感染是人肺孢子菌引起的肺孢子菌肺炎（C错），不仅是艾滋病患者所有的机会性感染中最常见的一种，也是患者最主要的死因。其病原体是耶氏肺孢子菌，是一种真菌。患者常见的临床表现为高热、呼吸急促、口唇发绀，伴有严重缺氧及呼吸衰竭。另外结核杆菌也是艾滋病患者最常合并的肺部感染菌种，也是其主要死因之一。隐球菌侵犯中枢神经系统引起感染（B错）。口腔毛状白斑侵犯口腔引起感染（D错）。巨细胞病毒和弓形虫性视网膜炎，巨细胞病毒（CMV）感染是艾滋病患者最常见的疱疹病毒感染（E错）。